女，30岁，妊娠35周，发现血压升高3周，今晨突然腹痛，呈持续性，阴道有少量流血，查体P12次/分，BP150/98mmHg，子宫张力大，宫底前壁压痛明显，胎心100次/分，尿蛋白（＋＋）。该患者最容易发生的并发症是
A. 子痫
B. 心力衰竭
C. 子宫破裂
D. DIC
E. 胎盘粘连

正确答案：D。DIC

解析：妊娠中晚期孕妇，发现血压高(收缩压≥140mmHg和（或）舒张压≥90mmHg），蛋白尿(++），诊断为子痫前期（胎盘早剥病因）。患者今晨突发剧烈腹痛，阴道少量流血、伴有子宫张力增高和子宫压痛，据其病史、体征及实验室检查，诊断为 1.子痫前期；2.胎盘早剥。常见并发症有胎儿宫内死亡、弥散性血管内凝血（DIC）、失血性休克、急性肾衰竭和羊水栓塞，对于较严重的胎盘早剥，因消耗大量凝血因子，最常导致并发症为DIC。